起自釉牙骨质界下方的牙骨质，将牙向牙槽窝内牵引的是
A. 牙槽嵴组
B. 水平组
C. 斜行组
D. 根间组
E. 根尖组

正确答案：A。牙槽嵴组

解析：牙槽嵴组：纤维起于釉牙骨质界下方的牙骨质，向外下方走行，止
于牙槽嵴顶。主要分布在牙的唇（颊）、舌（腭）侧，在邻面无此纤维。其功能是将牙向牙槽窝内牵引，对抗侧方力，保持牙直立。掌握“牙周膜”知识点。